未取得母婴保健技术相应合格证书、出具有关医学证明的，给予行政处罚应包括
A. 停业整顿
B. 罚款
C. 没收非法所得
D. 取消执业资格
E. 吊销执业证书

正确答案：B。罚款

解析：《母婴保健法》规定，未取得国家颁发的母婴保健技术相应合格证书，有下列行为之一的，县级以上地方人民政府卫生行政部门应当予以制止，并可根据情节给予警告或者处以罚款（B对）：①从事婚前医学检查、遗传病诊断或者医学技术鉴定的；②施行终止妊娠手术的；③出具法律规定的有关医学证明的。